阿托品的最低致死量
A. 成人为60～110mg、儿童约为8mg
B. 成人为70～120mg、儿童约为9mg
C. 成人为80～130mg、儿童约为10mg
D. 成人为90～140mg、儿童约为15mg
E. 成人为100～150mg、儿童约为18mg

正确答案：C。成人为80～130mg、儿童约为10mg

解析：阿托品的最低致死量：成人为80～130mg，儿童约为10mg。掌握“阿托品”知识点。